静止龋主要是在下列何种情况下产生的
A. 机体抵抗力增加
B. 牙齿再矿化能力增加
C. 牙面产生龋的环境消失
D. 口内致龋病菌减少
E. 牙齿的抗酸力增加

正确答案：C。牙面产生龋的环境消失

解析：本题考查静止龋。静止龋的产生主要是由于龋病发展到某一阶段时，牙面产生龋的环境消失（C对），如原有隐蔽部位变得开放，容易清洁，牙菌斑易受到唾液缓冲作用和冲洗力的影响，使龋损的进展停止。机体抵抗力增加（A错）、牙齿再矿化能力增加（B错）、口内致龋病菌减少（D错）、牙齿的抗酸力增加（E错）都可能减缓龋病的进展，但不会使病变停止。